备洞和充填过程中，保护牙髓的措施为
A. 高速钻机须有降温措施
B. 慢速手机去腐时应保持窝洞干燥
C. 切削牙体组织应采用间断磨除法
D. 深洞充填时需垫底
E. 包括以上各项

正确答案：E。包括以上各项

解析：本题考查保护牙髓的措施。高速钻机会产热，温度过高或者过低会对牙髓造成损伤，需随时用水冲洗窝洞，降低温度（A对）。慢速手机去除腐质保持窝洞干燥（B对），保证视野清晰，避免穿髓。切削牙体组织应采用间断磨除法（C对），减轻对牙髓的持续刺激。深龋洞充填时需要垫底，以隔绝温度和化学刺激，保护牙髓（D对），（ABCD均对，故E为本题的正确答案）。